治疗急性吐泻有速效的腧穴是
A. 太溪
B. 委中
C. 承山
D. 内关
E. 昆仑

正确答案：B。委中

解析：该题主要考察腧穴主治。委中属于足太阳膀胱经，位于腘横纹中点。委中主治腰背痛、下肢痿痹等腰及下肢病证；腹痛、急性吐泻等急症（B对）；瘾疹，丹毒；小便不利、遗尿。太溪主治头痛、目眩、失眠、健忘、遗精、阳痿等肾虚证；咽喉肿痛、齿痛、耳鸣、耳聋等阴虚性五官病证；咳嗽、气喘、咯血、胸痛等肺系疾患；消渴，小便频数，便秘；月经不调；腰脊痛，下肢厥冷，内踝肿痛（A错）。承山主治腰腿拘急、疼痛；痔疾，便秘；腹痛，疝气（C错）。内关主治心痛、胸闷、心动过速或过缓等心系病证；胃痛、呕吐、呃逆等胃腑病证；中风，偏瘫，眩晕，偏头痛；失眠、郁证、癫狂病等神志病证；肘、臂、腕挛痛（D错）。昆仑主治为后头痛，项强，目眩；腰骶疼痛，足踝肿痛；癫痫；滞产（E错）。